氰化物中毒抑制的是
A. 细胞色素b
B. 细胞色素c
C. 细胞色素c1
D. 细胞色素aa3
E. 辅酶Q

正确答案：D。细胞色素aa3

解析：氰化物中毒抑制的是细胞色素a₃（D对）。氰化物中CN⁻可紧密结合复合物Ⅳ中氧化型Cyta₃，阻断电子由Cyta到CuB-Cyta₃间传递，可使细胞内呼吸停止，与此相关的细胞生命活动停止，迅速引起死亡。